患者，女，28岁。产后1周突然出现左小腿肿胀，疼痛，皮温增高，浅静脉怒张，足背弯曲时腓肠肌疼痛明显，舌暗淡苔黄腻，脉弦滑。其治法除活血化瘀外，还应
A. 温阳通脉
B. 清利湿热
C. 温阳利水
D. 通络止痛
E. 消肿止痛

正确答案：B。清利湿热

解析：该患者小腿肿胀，疼痛，皮温增高，浅静脉怒张，足背弯曲时腓肠肌疼痛，符合股肿的诊断。水湿停留下肢，故见小腿肿胀，湿郁化热故见皮温增高，湿热阻络，故见疼痛、浅静脉怒张、足背弯曲时腓肠肌疼痛，舌暗淡苔黄腻，脉弦滑亦是湿热征象，故辨证为湿热下注，治宜清热利湿，活血化瘀（B对）。患者一片湿热征象，未见阳虚症状，不需温阳通脉（A错）。患者下肢肿胀，并非因阳虚水停，无形寒肢冷等症状，无需温阳利水（C错）。题干中已说明活血化瘀，再用通络止痛之法属重复，患者湿热象明显，当清利湿热（D错）。活血化瘀，淤血去则脉络通，血脉通则肿消痛无，消肿止痛之法亦有重复之嫌（E错）。